《药品生产质量管理规范》规定，产品生产管理文件主要有
A. 批生产记录
B. 批检验记录
C. 生产工艺规程
D. 岗位操作法
E. 标准操作规程

正确答案：A、C、D、E。批生产记录；生产工艺规程；岗位操作法；标准操作规程